颞下颌关节盘中最厚的部位在
A. 前带
B. 后带
C. 中间带
D. 双板区
E. 以上都不是

正确答案：B。后带

解析：关节盘位于关节窝、关节结节和髁突之间，呈椭圆形，内外径大于前后径。矢状方向上可根据厚度将关节盘分为前、中、后三带，其厚度依次约为2mm、1mm和3mm。掌握“颞下颌关节的解剖特点”知识点。